对于群体龈炎的流行程度标准估计，牙龈指数为中度流行的是
A. 0
B. 0.1～1.0
C. 1.1～2.0
D. 2.1～3.0
E. 3.1～4.0

正确答案：C。1.1～2.0

解析：掌握“牙周病流行病学及分级预防”知识点。牙龈炎流行程度评估：GI=0：无流行；GI=0.1-1：轻度流行；GI=1.1-2：中度流行；GI=2.1-3：重度流行。